人体动力单元主要包括
A. 神经、肌肉、韧带、血管
B. 血管、肌肉、骨骼、神经
C. 肌肉、骨骼、关节、韧带
D. 神经、肌肉、关节、骨骼
E. 神经、肌肉、软骨、血管

正确答案：B。血管、肌肉、骨骼、神经